为了研究45岁以上的男性中体重指数（BMI）≥25者糖尿病患病率是否高于体重指数＜25者，某医生共调查了9550人，其中BMI≥25者有2110人（n1），糖尿病患病人数为226人（X1）；BMI＜25者7440人（n2），其中糖尿病患病人数为310人（X2）。问BMI≥25者糖尿病患病率是否高于BMI＜25者。经u检验，若u值等于2.95，则最接近的概率P应是
A. P＞0.05
B. P＞0.03
C. P＞0.02
D. P＞0.01
E. P＜0.01

正确答案：E。P＜0.01

解析：因为区间μ±2.58σ范围内的面积约为99.00%，即μ＝2.58时，概率P=0.01。题中，μ＝2.95＞μ＝2.58，则P＜0.01（E对），即认为两个人群的糖尿病患病率有明显统计学意义。